能够将两个同质指标或不同性质指标进行对比的常用相对数为
A. 构成比
B. 相对比
C. 变异系数
D. 四分位数间距
E. 中位数

正确答案：B。相对比

解析：相对比所对比的两个指标，可以是同质指标，也可以是不同性质指标。掌握“分类资料的统计描述与推断”知识点。